好发于上颌切牙-尖牙区的牙瘤为
A. 成釉细胞瘤
B. 组合性牙瘤
C. 牙源性角化囊性瘤
D. 混合性牙瘤
E. 牙源性钙化上皮瘤

正确答案：B。组合性牙瘤

解析：组合性牙瘤：患者年龄较小，好发于上颌切牙-尖牙区。掌握“牙瘤”知识点。